一食堂，就餐者用餐1小时后，陆续出现唇指甲以及全身皮肤青紫等症状。根据中毒症状，中毒的原因最可能是
A. 钡盐中毒
B. 赤霉病中毒
C. 磷化锌中毒
D. 亚硝酸盐中毒
E. 黄变米中毒

正确答案：D。亚硝酸盐中毒

解析：本题为集体性食物中毒，就餐者食入1小时后陆续出现唇、指甲及全身皮肤青紫等症状即出现发绀表现，最可能的原因是误食亚硝酸盐后，血红蛋白中二价铁被氧化成三价铁导致血中高铁血红蛋白增多，引起“肠源性发绀”，患者可出现唇、指甲以及全身皮肤青紫等症状，因此本例最可能的中毒原因为亚硝酸盐中毒（D对）。钡盐中毒（A错）一般2～3小时后出现急性胃肠炎，重者引起低钾血症、四肢瘫痪、呼吸肌麻痹和心律失常，与本例不符。赤霉病中毒（B错）表现为恶心、眩晕、腹痛、呕吐、全身乏力，少数伴有腹泻、流涎，与本例不符。磷化锌中毒（C错）患者常有头晕、呕吐、胸闷，重者肺水肿、休克、惊厥、昏迷、心律失常、急性肾衰竭，与本例不符。黄变米中毒（E错）常以中枢神经系统麻痹、肝肾损害为主要临床表现，与本例不符。